牵牛子为峻下逐水药，其主治病证不包括
A. 水肿鼓胀
B. 痰饮喘满
C. 大便秘结
D. 癥瘕积聚
E. 虫积腹痛

正确答案：D。癥瘕积聚

解析：本题考查的是牵牛子的主治病证。牵牛子为峻下逐水药，其主治病证不包括癥瘕积聚（D错，为本题正确答案）。牵牛子：【主治病证】（1）水肿，鼓胀（A对），痰饮喘满（B对）。（2）大便秘结（C对），食积停滞。（3）虫积腹痛（E对）。癥瘕积聚为大黄的主治病证。大黄：【主治病证】（1）大便秘结，胃肠积滞，湿热泻痢初起。（2）火热上攻之目赤、咽喉肿痛、口舌生疮、牙龈肿痛。（3）热毒疮肿，水火烫伤。（4）血热之吐血、衄血、咯血、便血。（5）瘀血闭经，产后瘀阻腹痛，癥瘕积聚，跌打损伤。（6）湿热黄疸，淋证涩痛。